肺部支原体感染用
A. 阿莫西林
B. 红霉素
C. 头孢曲松
D. 林可霉素
E. 万古霉素

正确答案：B。红霉素